患者，男，48岁，入院诊断为细菌性脑膜炎，给予万古霉素联合头孢曲松经验性治疗，在静滴过程中出现红人综合征。对用药有关问题的分析，正确的有
A. 万古霉素与头孢曲松发生相互作用引起红人综合征
B. 万古霉素可引起红人综合征
C. 0.5g的万古霉素静脉滴注时间应在1h以上
D. 万古霉素应快速滴注以保证疗效
E. 每1g万古霉素至少用200ml溶媒稀释，静滴时应避光

正确答案：B、C。万古霉素可引起红人综合征；0.5g的万古霉素静脉滴注时间应在1h以上

解析：本题考查红人综合征。万古霉素不宜肌内注射或直接静脉注射，因滴注速度过快可致由组胺引起的非免疫性剂量相关反应，易出现“红人综合征”（B对A错）。每1g至少加入200ml液体，静脉滴注时间控制在2h以上，即0.5g的万古霉素静脉滴注时间应在1h以上（C对）。突击性大量注射可导致严重低血压，应控制滴注速度（D错）。